伤寒最严重的并发症是
A. 中毒性脑病
B. 肠穿孔
C. 急性胆囊炎
D. 肠出血
E. 肺炎

正确答案：B。肠穿孔

解析：伤寒的并发症有：①肠出血；②肠穿孔；③中毒性肝炎；④中毒性心肌炎；⑤其他并发症，如中毒性脑病（A错）、急性胆囊炎（C错）、肺炎（E错）等。其中最严重的并发症是肠穿孔（B对），最常见的并发症是肠出血（D错）。